从唇红至前鼻孔底部完全裂开的唇裂称为
A. 完全性唇裂
B. 不完全性唇裂
C. 上唇正中裂
D. 下唇裂
E. 综合征性唇裂

正确答案：A。完全性唇裂

解析：本题考查面部发育异常。从唇红至前鼻孔底部完全裂开的唇裂称为完全性唇裂（A对）。唇裂（cleflip），多见于上唇，是球状突和上颌突未融合或部分融合所致，发生在唇的侧方,单、双侧均可发生，单侧者较多。依病变程度可分为完全性和不完全性两种。从唇红至前鼻孔底部完全裂开为完全性唇裂；只在唇红缘有一个小切迹为不完全性唇裂（B错）。上唇正中裂（C错）为两侧球状突中央部分未融合或部分融合；下唇裂（D错）为两侧下颌突在中线未融合，这种唇裂罕见。综合性唇裂（E错）为一些面部发育异常性综合征可伴发唇裂。